应激C-反应蛋白的增加
A. 增强抗出血能力
B. 增强抗感染能力
C. 两者均可
D. 两者均否
E. 无

正确答案：B。增强抗感染能力

解析：应激C-反应蛋白的增加能发挥抗体样调理作用和活补体经典途经，从而能增强抗感染能力（B对）。